社会经济发展水平在一定程度上决定着人口再生产模式，工业模式的主要特征是
A. 高出生、高死亡、低寿命
B. 高出生、高死亡、低自然增长
C. 高出生、低死亡、高寿命
D. 低出生、高死亡、低自然增长
E. 低出生、低死亡、低自然增长

正确答案：E。低出生、低死亡、低自然增长